患者，女，68岁，因癌痛使用芬太尼透皮贴剂。关于该患者用药教育的说法，错误的是
A. 一贴可持续贴用72小时
B. 宜贴于无毛发的皮肤上
C. 避免贴在皮肤破损、红肿的部位
D. 避免贴在皮肤褶皱处
E. 宜热敷，促进药物吸收

正确答案：E。宜热敷，促进药物吸收

解析：本题考查透皮贴剂的注意事项。关于该患者用药教育的说法，错误的是宜热敷，促进药物吸收（E错，为本题正确答案）。使用透皮贴剂时宜注意：①用前将所要贴敷部位的皮肤清洗干净，并稍稍晾干；②从包装内取出贴片，揭去附着的薄膜，但不要触及含药部位；③贴于无毛发或是刮净毛发的皮肤上（B对），轻轻按压使之边缘与皮肤贴紧，不宜热敷；④皮肤有破损、溃烂、渗出、红肿的部位不要贴敷（C对）；⑤不要贴在皮肤的皱褶处（D对）、四肢下端或紧身衣服底下，选择一处不进行剧烈运动的部位，如胸部或上臂；⑥定期或遵医嘱更换，若发现给药部位出现红肿或刺激症状，可向医生咨询。芬太尼透皮贴剂可持续贴用72小时（A对）。